男，29岁，因外伤致上前牙缺失。查：左上1缺失，右上1残根，根断面平龈缘，根稍短，欲设计为2|2烤瓷固定义齿修复。其理由是
A. 增加基牙抗力
B. 增加前牙美观
C. 增加义齿支持
D. 增加义齿牢固度
E. 提高义齿切割能力

正确答案：C。增加义齿支持

解析：左上1缺失，由两边牙齿，也就是左上2和右上1做基牙即可，但是由于右上1是残根，并且根稍短，所以设计增加一颗牙齿来支持。掌握“固定桥的组成和分类”知识点。